男性，40岁，顽固性十二指肠溃疡2年，拟行手术治疗，该病人可选择的手术方式不包括
A. 毕Ⅰ式胃大部切除术
B. 毕Ⅱ式胃大部切除术
C. 迷走神经干切断术
D. 选择性迷走神经切断术
E. 高选择性迷走神经切断术

正确答案：A。毕Ⅰ式胃大部切除术

解析：毕（Billroth）Ⅰ氏胃大部切除术是在远端胃大部切除后，残胃与十二指肠吻合，吻合口张力较大；毕（Billroth）Ⅱ氏胃大部切除术是在切除远端胃后，缝合关闭十二指肠残端，残胃与上段空肠端侧吻合，吻合口张力较小（七版外科学P431-P432）。由于十二指肠溃疡患者的基础胃酸分泌量较多，行胃大部切除术时，胃切除范围较大，为避免术后吻合口张力较大导致吻合口瘘，应首选毕Ⅱ式胃大部切除术（B对），而不选毕Ⅰ式胃大部切除术（A错，为本题正确答案）。胃的运动和分泌主要受交感和副交感神经支配，副交感神经兴奋时胃的运动和分泌增强，而十二指肠溃疡的发病与胃酸分泌过多密切相关，因此各种迷走神经切断术（CDE对）均可应用于治疗十二指肠溃疡。